以下哪项不是铸造全冠的适应证
A. 固定义齿的固位体
B. 修改牙齿外形
C. 恢复咬合
D. 牙本质过敏
E. 残根

正确答案：E。残根

解析：本题考查铸造全冠的适应证。对于残根（E错，为本题正确答案），自身无法提供足够的抗力形和固位形，不能直接使用铸造全冠进行修复，可以考虑能否进行桩核冠修复，否则只能拔除。铸造全冠的适应症很广泛，可以用来作为固定义齿的固位体（A对），牙周夹板的固位体；若牙齿外形、咬合等不满意，可用全冠来修改牙齿外形（B对），恢复咬合（C对），满足对美观和功能的需求；可以用来治疗牙本质过敏（D对），将整个敏感的基牙保护起来，免受外界刺激。